尖牙卡环卡环臂在唇面进入
A. 邻间点
B. 颊侧倒凹区
C. 舌侧倒凹区
D. 近中倒凹区
E. 远中倒凹区

正确答案：D。近中倒凹区

解析：尖牙卡环：专门用于尖牙上。设近中切支托，卡环由切支托顺舌面近中切缘嵴向下，至舌隆突，方向上转，沿舌面远中边缘嵴至远中切角，反折至唇面，卡环臂在唇面进入近中倒凹区。此卡环的支持、固位作用较好。掌握“局部义齿固位体”知识点。